银汞合金与牙齿的固位是
A. 固位形
B. 螯合
C. 机械粘接
D. 汞齐化
E. 化学粘接

正确答案：A。固位形

解析：本题考查银汞合金与牙齿的固位。银汞合金与牙齿的固位是固位形（A对），即机械固位，窝洞要预备成典型的盒状洞形，且要增加辅助固位形，以使充填体有良好的固位。螯合（B错）是一个化学反应，不是固位原理的范畴。银汞合金与牙齿组织之间没有粘结性（CE错）。汞在室温下能与固体状态下的金属粉末经调和后形成合金，这种合金化的过程称为汞齐化（D错）。